西司他丁和亚胺培南组成复方制剂的原因是
A. 诱导细菌对前者的耐药
B. 易发生交叉过敏反应
C. 两种药物会形成复合物沉淀
D. 促进前者在肝脏的代谢
E. 阻止后者在肾脏被灭活

正确答案：E。阻止后者在肾脏被灭活

解析：本题考查西司他丁的应用。亚胺培南在近端肾小管中被正常人类肾脱氢肽酶Ⅰ灭活，西司他丁是这种脱氢肽酶的特异性抑制剂，故联用西司他丁可防止亚胺培南被灭活（E对）。